中医认为流行性腮腺炎的病位主要在
A. 太阳经脉
B. 少阳经脉
C. 阳明经脉
D. 太阴经脉
E. 少阴经脉

正确答案：B。少阳经脉

解析：流行性腮腺炎为感受风温时邪，从口鼻而入，侵犯足少阳胆经，邪毒壅阻于足少阳经脉，与气血相搏，凝结于耳下腮部所致（B对）。